属于牙周疾病二级预防概念
A. 专业性洁治
B. 刷牙
C. 袋内刮治
D. 恢复缺失牙
E. 根面平整

正确答案：A、C、E。专业性洁治；袋内刮治；根面平整

解析：本题考查牙周病流行病学及分级预防。牙周病的二级预防旨在早期发现、早期诊断、早期治疗，减轻已发生的牙时病的严重程度，控制其发展。对局限于牙龈的病变，及时采取专业性洁治，去除菌斑和牙石。控制其进一步发展。采用X线检查法定期追踪观察牙槽骨情况，根据具体情况采取适应的治疗，改善牙周组织的健康状况。二级预防的效果是在一级预防基础上取得的，其远期效果与患者是否能长期坚持各种预防措施有关。刷牙（B错）属于牙周病的一级预防；专业性洁治（A）、袋内刮治（C）、根面平整（E）属于牙周病的二级预防；恢复缺失牙（D）属于牙周病的三级预防。